维系蛋白质分子二级结构的化学键是
A. 二硫键
B. 离子键
C. 疏水键
D. 氢键
E. 肽键

正确答案：D。氢键

解析：氢键是维系蛋白质二级结构的主要化学键。掌握“蛋白质结构与功能关系”知识点。